休克病人采取何种体位最为合理
A. 头低，足高
B. 平卧位
C. 头部抬高，下肢抬高
D. 侧卧位
E. 头躯于抬高，下肢低垂

正确答案：C。头部抬高，下肢抬高

解析：本题考查休克。休克的急救措施：尽快控制活动性大出血，保持呼吸道通畅，尽量使患者安静，避免过多搬动，适当抬高头部和下肢（C对），通风、吸氧、保暖。本题考查休克。